下列哪项不是传染病个案调查的内容
A. 核实诊断
B. 确定传染来源及可能的传播途径
C. 确定病人传播范围
D. 查明全部接触者
E. 计算平均潜伏期并推算暴露日期

正确答案：E。计算平均潜伏期并推算暴露日期

解析：本题考查传染病个案调查的内容。传染病个案调查的内容包括：核实诊断（A对）；确定传染来源及可能的传播途径（B对）；确定病人传播范围（C对）；查明全部接触者（D对）。计算平均潜伏期并推算暴露日期（E错，为本题正确答案）不是传染病个案调查的内容。